佝偻病后遗症多见于
A. 3～6个月
B. 5～9个月以后
C. 6个月以后
D. 2岁以后
E. 3岁以后

正确答案：D。2岁以后

解析：本题考查维生素D缺乏性佝偻病的相关病征。维生素D缺乏性佝偻病的后遗症期多见于2岁以上（D对ABCE错）的儿童。若维生素D缺乏持续存在，骨骼损害程度较重，会残留不同程度的骨骼畸形。后遗症期无任何临床症状，血生化正常，X线检查骨骼干骺端病变消失。